以下关于绷带包扎的注意事项的描述中，不恰当的是
A. 无菌创口在包扎时覆盖的无菌纱布，应有一定的厚度和范围
B. 绷带在包绕颌下区和颈部时，应防止压迫喉头和气管
C. 压力应均匀适度，防止组织因过度受压而坏死
D. 腮腺区创口的包扎，不应施压，以免组织坏死
E. 整形手术后的创口包扎，压力不宜过重，以免影响组织的血运

正确答案：D。腮腺区创口的包扎，不应施压，以免组织坏死

解析：腮腺区创口的包扎，应施以一定压力，并应富于弹性，以免发生涎瘘。掌握“口外创口处理”知识点。